预防感染和局部抗感染治疗使用抗菌药物的原则为
A. 使用非限制级抗生素
B. 使用耐药性强抗生素
C. 使用限制级抗生素
D. 使用特殊限制级抗生素
E. 使用不易产生耐药性抗生素

正确答案：A。使用非限制级抗生素

解析：医疗机构和医务人员应当严格掌握使用抗菌药物预防感染的指证。预防感染、治疗轻度或者局部感染应当首选非限制使用级抗菌药物（A对）；严重感染、免疫功能低下合并感染或者病原菌只对限制使用级抗菌药物敏感时，方可选用限制使用级抗菌药物（C错）。特殊使用级抗菌药物（D错）不得在门诊使用。